下列可引起中性粒细胞生理性增多的是
A. 睡眠
B. 妊娠末期
C. 休息
D. 缺氧
E. 情绪激动

正确答案：B。妊娠末期

解析：中性粒细胞生理性增多可见于妊娠末期（B对）。睡眠（A错）、休息（C错）、缺氧（D错）、情绪激动（E错）一般中性粒细胞计数正常。